心输出量减少、外周阻力升高不是下列哪型休克的血液动力学特点
A. 心源性休克
B. 感染性休克
C. 过敏性休克
D. 失血性休克
E. 创伤性休克

正确答案：C。过敏性休克

解析：过敏性休克（C错）血管活性物质导致后微动脉、毛细血管前括约肌舒张和血管通透性增加，外周阻力明显降低，真毛细血管大量开放，血容量和回心血量急剧减少，动脉血压迅速而显著地下降。心源性休克（A对）心泵功能障碍导致的心输出量迅速减少，其中低排高阻型休克大多数患者表现为外周阻力增高。感染性休克（B对）即脓毒性休克，其中低动力型休克具有心排出量减少、外周阻力增高、脉压明显缩小等特点。失血性休克（D对）和创伤性休克（E对）属于低血容量性休克，低血容量性休克的典型临床表现为三低一高：即中心静脉压(CVP)、心排血量(CO)及动脉血压降低，而外周阻力(PR)增高。